胰岛素瘤来源于胰腺
A. A细胞
B. B细胞
C. G细胞
D. D细胞
E. D1细胞

正确答案：B。B细胞

解析：胰岛素瘤来源于胰腺B细胞（B对）。胰高血糖素瘤来源于胰腺A细胞（A错）；胃泌素瘤来源于胰腺G细胞（C错）；生长抑素瘤来源于胰腺D细胞（D错）；血管活性肠肽瘤来源于胰腺D1细胞（E错）。